外源性凝血系统的作用起始于
A. 组织受伤释放组织因子Ⅲ
B. 凝血酶的形成
C. 第Ⅻ因子被激活
D. 血小板第三因子的释放
E. 第Ⅹ因子被激活

正确答案：A。组织受伤释放组织因子Ⅲ

解析：外源性凝血系统的作用起始于组织受伤释放组织因子Ⅲ（A对）。外源性凝血过程：当血管损伤时，暴露出组织因子（FⅢ），后者与FⅦa相结合而形成FⅦa-组织因子复合物，其可催化FⅩ激活为FⅩa（E错），进而形成FⅩa-FⅤa-Ca²⁺-磷脂化合物，即凝血酶原酶复合物，其可使凝血酶原酶激活为凝血酶（B错），后者催化纤维蛋白原变为纤维蛋白单体，从而起到凝血的作用。内源性凝血途径起始于Ⅻ因子的激活（C错）。血小板第三因子（D错）是血小板参与凝血过程的重要因子。